下列关于下颌前牙髓腔形态的相关描述中，不恰当的是
A. 下颌切牙髓腔呈窄长三角形
B. 下颌切牙近切嵴部分的髓室最宽
C. 下颌切牙颈部横剖面髓室的唇舌径大于近远中径
D. 下颌切牙根中横剖面呈椭圆形或圆形
E. 下颌切牙不会出现唇、舌向两根管

正确答案：E。下颌切牙不会出现唇、舌向两根管

解析：本题考查下颌前牙髓腔的形态特点。下颌切牙不会出现唇、舌向两根管（E错，为本题正确答案）不符合下颌前牙髓腔形态的描述。下颌切牙根管多为窄而扁的单根管，但有少数分为唇舌两管，约占4%。下颌切牙髓腔呈狭长的三角形（A对），三角形的底为髓室顶，位置接近牙冠中1/3，近切嵴部分最宽（B对），向颈缘逐渐缩小，从颈缘起向根尖明显缩小。下颌切牙髓腔体积较小，唇舌径大于近远中径（C对）。牙根中部横剖面呈椭圆形或圆形（D对），均位居中央。呈圆形者根管显著缩小；呈椭圆形者，根管近远中径较窄。平牙根中部近远中根管壁薄，根管预备时，应注意此厚度，以免侧穿。